幼年类风湿性关节炎发作期中医主要辨证方法是
A. 疫疠痰食辨证
B. 卫气营血辨证
C. 八纲辨证
D. 六淫辨证
E. 脏腑辨证

正确答案：B。卫气营血辨证

解析：幼年类风湿性关节炎是一种以正气亏虚、肝肾不足为本，风、寒、湿、热邪痹阻关节经络，久则痰瘀阻络为标的慢性反复发作性疾病。在发作期以卫气营血辨证为主（B对），缓解期以股脏腑辨证为主（ACDE错）。